依据《处方药与非处方药流通管理暂行规定》，进入药品流通领域的非处方药
A. 药品包装上印制醒目的警示语或忠告语
B. 可以不凭医师处方销售、购买和使用
C. 药品使用说明书上印制醒目的警示语和忠告语
D. 药品包装警示语和忠告语为：凭医师处方销售、购买和使用处方药
E. 药品包装警示语和忠告语为：请仔细阅读药品使用说明书或在药师指导下购买和使用

正确答案：A、B、C、E。药品包装上印制醒目的警示语或忠告语；可以不凭医师处方销售、购买和使用；药品使用说明书上印制醒目的警示语和忠告语；药品包装警示语和忠告语为：请仔细阅读药品使用说明书或在药师指导下购买和使用

解析：本题考查方药与非处方药流通管理。依据《处方药与非处方药流通管理暂行规定》，进入药品流通领域的非处方药药品包装上印制醒目的警示语或忠告语（A对）；药品使用说明书上印制醒目的警示语和忠告语（C对）；可以不凭医师处方销售、购买和使用（B对）；药品包装警示语和忠告语为：请仔细阅读药品使用说明书或在药师指导下购买和使用（E对）。